女，36岁，心悸怕热多汗3个多月，体重下降5kg。查体：无突眼，双手细颤，甲状腺Ⅱ°肿大，可闻及血管杂音，心率108/分，结合实验室检查确诊为Graves病甲亢。白细胞3.0×10⁹/L，肝功能ALT46U/L，AST36U/L。患者能否用核素I¹³¹治疗的关键检查是
A. 肝功能
B. 血白细胞计数
C. 抗甲状腺抗体水平
D. 甲状腺核素扫描
E. 甲状腺I¹³¹摄取率

正确答案：E。甲状腺I¹³¹摄取率

解析：¹³¹I治疗甲亢的机制是¹³¹I被甲状腺摄取后释放出β射线，破坏甲状腺组织细胞。因此，其治疗的前提是甲状腺能摄取¹³¹I。故在行¹³¹I治疗前，必须测定甲状腺¹³¹I摄取率（E对）。¹³¹I在体内主要被甲状腺摄取，对甲状腺以外的脏器，如肝脏、血液系统不造成急性辐射性损伤，因此用¹³¹I治疗前，不必检查肝功能（A错）、血白细胞计数（B错）。抗甲状腺抗体水平（C错）为诊断Graves病甲亢的重要指标之一，与能否用¹³¹I治疗无关。甲状腺核素扫描（D错）主要用于高功能腺瘤的诊断。